下列不能用于根管充填术根管消毒药物的是
A. 氢氧化钙
B. 甲醛甲酚
C. 樟脑酚
D. 木榴油
E. 氧化锌

正确答案：E。氧化锌

解析：根管充填术中常用根管消毒：根管内封入氢氧化钙制剂或髓室内放置蘸有甲醛甲酚、樟脑酚或木榴油的不饱和小棉球，氧化锌丁香油糊剂暂封窝洞。掌握“乳牙牙髓病及根尖周病诊断及治疗”知识点。